清瘟败毒饮适用于治疗系统性红斑狼疮的哪个证型
A. 热毒血瘀证
B. 脾肾两虚
C. 阴虚内热
D. 气血两虚
E. 水瘀互结

正确答案：A。热毒血瘀证

解析：犀角地黄汤加减可以清热解毒，化瘀消斑。用于治疗系统性红斑狼疮热毒血瘀证（A对）。治疗脾肾两虚证（B错），方选附子理中汤合金匮肾气丸加减。治疗阴虚内热证（C错），方选玉女煎合增液汤加减。治疗气血两虚证（D错），方选八珍汤加减。治疗水瘀互结证（E错），方选桃红四物汤合五苓散加减。